对霍奇金淋巴瘤最具诊断意义的细胞是
A. R-S细胞
B. 霍奇金细胞
C. 陷窝细胞
D. 多形性瘤细胞
E. 嗜酸性细胞

正确答案：A。R-S细胞

解析：本题考查淋巴瘤。R-S细胞（A对）见于霍奇金淋巴瘤，是霍奇金淋巴瘤含有的一种独特的瘤巨细胞即Reed－Sternberg细胞（简称R-S细胞）。